生产日期的英文缩写是
A. DL
B. LD
C. ED
D. Exp
E. MFD

正确答案：E。MFD